下列被称为“元神之府”的是
A. 脑
B. 髓
C. 骨
D. 脉
E. 胆

正确答案：A。脑

解析：该题考查奇恒之府的别称。脑为元神之府（A对）。髓为骨之充（B错）。骨为髓之府（C错）。脉为血之府（D错）。胆有“中精之府”、“清净之府”或“中清之府”之称（E错）。